肝病传肺属于
A. 相侮传变
B. 制化传变
C. 母病及子
D. 相乘传变

正确答案：A。相侮传变

解析：五行之中，肝属木，肺属金，金克木，肝病传肺，是肝对所不胜的肺反向制约和克制，属相侮传变（A对）。制化传变指五行之间逆相生化，又逆相制约，生化中有制约，制约中有生化，二者相辅相成，从而维持其相对平衡和正常的协调关系（B错）。母病及子是指五行中的某一行异常，累及其子行，导致母子两行皆异常，肝肺无母子关系（C错）。相乘指五行中所不胜一行对其所胜一行的过度制约或克制（D错）。